婴幼儿食物能量供给不足时，不会出现
A. 影响其他营养素在体内的利用
B. 动用自身的能量储备
C. 生长发育迟缓、消瘦、活动力减弱
D. 严重的肌肉和脂肪消耗
E. 体重为同年龄儿童平均体重的40%~50%

正确答案：E。体重为同年龄儿童平均体重的40%~50%